一患者，皮肤黄染不断加深，身体日渐消瘦，大便持续变白，碱性磷酸酶增高应考虑的疾病是
A. 肝硬化
B. 胰头癌
C. 肝癌
D. 病毒性肝炎
E. 胆石症

正确答案：B。胰头癌

解析：胆汁淤积性黄疸是由于胆道梗阻，梗阻以上的胆管压力增高，胆管扩张，最终肝内小胆管及毛细胆管破裂，胆红素随胆汁直接进入血液循环，故血中CB增高。由于胆红素“肠肝循环”被阻断，故尿胆原减少甚至消失，所以皮肤黄染不断加深，身体日渐消瘦，大便持续变白，碱性磷酸酶增高（B对）。肝硬化、肝癌、病毒性肝炎引起的是肝细胞性黄疸，临床表现为①皮肤颜色呈浅黄至深黄，部分患者有皮肤瘙痒。②肝病本身表现：如急性肝炎者有发热、乏力、纳差、恶心、呕吐、肝区疼痛等表现；慢性肝病者可有蜘蛛痣、肝掌、脾肿大或腹水等（ACD错）。胆石症不会引起大幅度的消瘦，但是体重会有相应的下降（E错）。